肝素抗凝作用的主要机制是
A. 直接灭活凝血因子
B. 激活血浆中的AT-Ⅲ
C. 与血浆中Ca²⁺结合
D. 激活纤溶酶原活性
E. 抑制肝脏合成凝血因子

正确答案：B。激活血浆中的AT-Ⅲ